根据《药品注册管理办法》，按照药品补充申请的是
A. 对已上市药品改变剂型的注册申请
B. 对已上市药品改变给药途径的注册申请
C. 对已上市药品增加新适应症的注册申请
D. 对已上市药品增加原批准事项的注册申请
E. 对境外生产的药品在中国境内上市销售的注册申请

正确答案：D。对已上市药品增加原批准事项的注册申请

解析：本题考查药品补充申请。根据《药品注册管理办法》第八章，补充申请：新药申请、仿制药申请或者进口药申后，改变、增加、取消原批准事项或内容（D对）的注册申请。